未按照规定使用安全防护装置和个人防护用品的由县级以上卫生行政部门
A. 处3千元以下的罚款
B. 处5千元以下的罚款
C. 处1万元以下的罚款
D. 处2万元以下的罚款
E. 处3万元以下的罚款

正确答案：C。处1万元以下的罚款

解析：医疗机构违反放射诊疗管理规定，有下列行为之一的，由县级以上卫生行政部门给予警告，责令限期改正；并可处1万元以下的罚款：①购置、使用不合格或国家有关部门规定淘汰的放射诊疗设备的；②未按照规定使用安全防护装置和个人防护用品的；③未按照规定对放射诊疗设备、工作场所及防护设施进行检测和检查的；④未按照规定对放射诊疗工作人员进行个人剂量监测、健康检查、建立个人剂量和健康档案的；⑤发生放射事件并造成人员健康严重损害的；⑥发生放射事件未立即采取应急救援和控制措施或者未按照规定及时报告的；⑦违反放射诊疗管理规定的其他情形。掌握“放射诊疗的防护与法律责任”知识点。